十二经脉的命名，主要包含了下列哪些内容
A. 阴阳、五行、脏腑
B. 五行、手足、阴阳
C. 手足、阴阳、脏腑
D. 脏腑、手足、五行
E. 以上均非

正确答案：C。手足、阴阳、脏腑

解析：该题考查十二经脉的名称。十二经脉的名称由手足、阴阳、脏腑三部分构成。从正经十二脉的名称也可以推断出如：足厥阴肝经（C对）。十二经脉的名称应严格按照手足、阴阳、脏腑的顺序。五行，即是木、火、土、金、水五种物质的运动十二经脉名称不包含（ABD错）。